男，反复便秘、腹痛10年。便前腹痛、腹部不适，便后缓解。工作紧张时症状加重。无便血及消瘦，睡眠差。最有可能的诊断是
A. 肠易激综合征
B. 克罗恩病
C. 肠结核
D. 结肠癌
E. 溃疡性结肠癌

正确答案：A。肠易激综合征

解析：男性患者，腹部不适超过6个月，便后不适可缓解；腹部不适与精神等因素相关（肠易激综合征常见症状特点），无明确相关形态学改变和生化异常（肠易激综合征多无器质性改变）。结合上述病史和临床表现，最有可能的诊断是肠易激综合征（A对）。克罗恩病（B错）、肠结核（C错）、结肠癌（D错）和溃疡性结肠炎（E错）一般有便血或消瘦等警报症状（提示器质性疾病），病情变化与情绪无关。